下列不属于急性病毒性心肌炎常见临床表现的是
A. 先有发热，然后出现心悸、胸闷
B. 恶心、呕吐等消化道症状
C. 可合并各种心律失常
D. 常出现器质性心脏杂音
E. 心动过速与发热程度平行

正确答案：E。心动过速与发热程度平行

解析：急性病毒性心肌炎常见临床表现为1～3周有病毒感染前驱症状，如发热或恶心呕吐等消化道症状（B对），随后可出现心悸胸闷、呼吸困难（A对），绝大部分以心律失常为主诉或首见症状（C对），由于心脏扩大致二尖瓣关闭不全或相对狭窄，此时常出现器质性心脏杂音（D对），心肌炎好转后杂音可消失，但心动过速和发热程度不相称（E错，为本题正确答案）。